人类免疫缺陷病毒（HIV）可侵犯多种免疫细胞，最主要受侵犯的细胞是
A. 单核巨噬细胞
B. 小神经胶原细胞
C. B淋巴细胞
D. CD4⁺T细胞
E. 骨髓干细胞

正确答案：D。CD4⁺T细胞